关于视辐射的说法何者正确
A. 经过内囊后脚
B. 含有双眼视网膜来的纤维
C. 损伤后瞳孔对光反射不受影响
D. 以上都对
E. 以上都不对

正确答案：D。以上都对

解析：视辐射由外侧膝状体核发出纤维组成，，含有来自对侧颞侧和同侧鼻侧的双侧视网膜纤维（B对），经过内囊后脚（A对），与视觉传导有关。瞳孔对光反射的通路如下：视网膜—视神经一视交叉一视束一上丘臂一顶盖前区一两侧动眼神经副核一动眼神经一睫状神经节一节后纤维一瞳孔括约肌收缩一两侧瞳孔缩小，不含有视辐射，所以视辐射损伤后瞳孔对光反射不受影响（C对，D为本题正确答案）。